凡与用药目的无关，并为病人带来不适或痛苦的反应统称为
A. 副作用
B. 毒性反应
C. 停药反应
D. 变态反应
E. 药物不良反应

正确答案：E。药物不良反应

解析：凡与用药目的无关，并为病人带来不适或痛苦的反应统称为药物不良反应。掌握“药物不良反应”知识点。